采用标准加入法验证阿司匹林片含量测定的准确度，精密称取片剂粉末15.00mg（已知含阿司匹林10.00mg），向其中准确加入阿司匹林12.50mg，依法测定，测得阿司匹林总量为22.50mg，方法回收率的计算结果为
A. 回收率（%）=22.50/15.00*100%=150.0%
B. 回收率（%）=12.50/10.00*100%=125.0%
C. 回收率（%）=（22.5-10.0）/12.5*100%=100%
D. 回收率（%）=10.0/12.5*100%=80.0%
E. 回收率（%）=（22.5-15.00）/12.50*100%=60.0%

正确答案：C。回收率（%）=（22.5-10.0）/12.5*100%=100%

解析：本题考查回收率的计算。回收率p=（加标试样测定值-试样测定值）/加标量×100%，即回收率（%）=（22.5-10.0）/12.5*100%=100%（C对）。